男，14岁。右大腿深部巨大血管瘤，术后情况良好，伤口一期愈合。拆线后下床活动5分钟后，突然晕倒，抢救无效死亡。应考虑
A. 脑血管意外
B. 心肌梗死
C. 休克致死
D. 肺动脉栓塞
E. 脂肪栓塞

正确答案：D。肺动脉栓塞

解析：右大腿深部巨大血管瘤术中可能损伤股静脉，加之术后长时间卧床，易造成股静脉血栓形成。拆线后下床活动，在下肢肌肉的挤压作用下，股静脉血栓脱落，易造成肺动脉栓塞（D对），可致患者迅速死亡。脑血管意外多见于中老年高血压动脉硬化病人，多发生于左心血栓脱落（A错）。心肌梗死多见于老年人动脉粥样硬化（B错）。休克致死常有收缩压降至90mmHg以下及少尿等症状（C错）。脂肪栓塞（P55）的栓子常来源于长骨骨折、脂肪组织严重挫伤和烧伤（E错）。